经产妇，40岁。近2年痛经并逐渐加重，伴经量增多及经期延长，届时需服强止痛药。查子宫均匀增大如孕8周，质硬，有压痛，经期压痛明显。痛经逐渐加重的原因，最可能的是
A. 功能性痛经
B. 子宫腺肌病
C. 子宫内膜结核
D. 子宫内膜癌
E. 子宫黏膜下肌瘤

正确答案：B。子宫腺肌病

解析：患者为中年经产妇（子宫腺肌病多发生于30～50岁经产妇）出现进行性加重的痛经，经量增多，经期延长（其主要症状是经量过多、经期延长和逐渐加重的进行性痛经），妇检：子宫均匀增大如孕8周，质硬，有压痛，经期压痛明显（妇科检查子宫呈均匀增大或有局限性结节隆起，质硬且有压痛，经期压痛更甚），应诊断为子宫腺肌病（B对），为其痛经逐渐加重的最可能原因。功能性痛经（P362）（A错）又称原发性痛经，无器质性病变，疼痛多自月经来潮后开始，持续2～3日后缓解，疼痛常呈痉挛性，妇科检查无异常发现。子宫内膜结核（P265-P266）（C错）可有低热盗汗、不孕、月经失调等表现，但子宫大小、形态无明显变化。子宫内膜癌（P315）（D错）常表现绝经后不规则阴道流血，无进行性痛经。子宫黏膜下肌瘤（P311）（E错）常有经量增多及经期延长，若伴感染时可有坏死、出血及脓性分泌物，但无痛经。